根据《中共中央国务院关于深化医药卫生体制改革的意见》，到2020年的总体目标包括
A. 普遍建立比较完善的公共卫生服务体系
B. 普遍建立比较完善的医疗服务体系
C. 普遍建立比较完善的药品供应保障体系
D. 普遍建立比较建全的医疗保障体系
E. 普遍建立比较科学的医疗卫生机构管理体制和运行体制

正确答案：A、B、C、D、E。普遍建立比较完善的公共卫生服务体系；普遍建立比较完善的医疗服务体系；普遍建立比较完善的药品供应保障体系；普遍建立比较建全的医疗保障体系；普遍建立比较科学的医疗卫生机构管理体制和运行体制

解析：本题考查深化医药卫生体制改革。根据《中共中央国务院关于深化医药卫生体制改革的意见》，到2020年覆盖城乡居民的基本医疗卫生制度基本建立。普遍建立比较完善的公共卫生服务体系（A对）和医疗服务体系（B对），比较健全的医疗保障体系（D对），比较规范的药品供应保障体系（C对），比较科学的医疗卫生机构管理体制和运行机制（E对），形成多元办医格局，人人享有基本医疗卫生服务，基本适应人民群众多层次的医疗卫生需求，人民群众健康水平进一步提高。